病变不在
A. 右侧薄束
B. 右侧内侧丘系
C. 左侧内侧丘系
D. 丘系交叉
E. 左侧内囊

正确答案：B。右侧内侧丘系

解析：本体感觉是指肌、腿、关节等在不同状态（运动或静止）时产生的感觉（例如，人在闭眼时能感知身体各部的位置），又称深感觉，包括位置觉、运动觉和震动觉。移动患者右脚拇趾, 不能说清运动方向，为位置觉感觉障碍。躯干和四肢意识性本体感觉和精细触觉传导通路：第1级神经元为脊神经节内假单极神经元，第2级神经元在薄束核和楔束核内，二者发出的纤维在中线上交叉后形成内侧丘系交叉，第3级神经元的胞体在丘脑腹后外侧核，最后经内囊投射至中央后回。患者右侧深感觉障碍，经右侧薄束核上传（A对），再经丘系交叉（D对）后至左侧内侧丘系（B错，为本题正确答案），左侧内囊（E对）。